中医收集病情的基本方法是
A. 诊断
B. 诊病
C. 诊法
D. 辨证
E. 论治

正确答案：C。诊法

解析：诊法，是中医诊察、收集病情资料的基本方法和手段，主要包括望、闻、问、切“四诊”（C对）。“诊断”就是通过对患者的询问、检查，以掌握病情资料，进而对患者的健康状态和病变本质进行辨识，并做出概括性判断（A错）。诊病，亦称辨病，是以中医学理论为指导，综合分析四诊资料，对疾病的病种做出判断，得出病名的思维过程（B错）。“辨证”是在中医学理论的指导下，对患者的各种临床资料进行分析，从而对疾病当前的病位与病性等本质做出判断，并概括为完整证名的诊断思维过程（D错）。论治又称施治，是根据辨证的结果，确定相应的治疗方法（E错）。